膈的食管裂孔位于
A. 第8胸椎
B. 第9胸椎
C. 第10胸椎
D. 第11胸椎
E. 第12胸椎

正确答案：C。第10胸椎

解析：膈的食管裂孔为食管的第3狭窄处，位于第10胸椎(C对)。